患者排泄物的消毒可用
A. 0.01%～0.1%硫柳汞
B. 1%硝酸银
C. 3%～6%过氧化氢
D. 含有0.2～0.5ppm氯
E. 生石灰

正确答案：E。生石灰

解析：酸碱类：生石灰加水配成12.5%～25%糊状液，用于排泄物及地面的消毒。掌握“消毒与灭菌”知识点。